患者痢下赤白，白多赤少，腹痛，里急后重，饮食乏味，胃脘饱胀，舌淡苔白腻，脉濡缓。其证候是
A. 疫毒痢
B. 湿热痢
C. 阴虚痢
D. 休息痢
E. 寒湿痢

正确答案：E。寒湿痢

解析：题中患者以腹痛拘急，痢下赤白，白多赤少，里急后重为主症，故诊断为痢疾。里急后重为寒湿之邪滞留肠胃，寒主收引，湿邪凝滞，气机阻滞证所致，寒湿之邪伤于气分，故痢下赤白，白多赤少；寒湿困脾，脾失健运，故胃脘饱胀。舌淡苔白腻，脉濡缓为寒湿内盛之象，故辨为寒湿痢（E对）。疫毒痢起病急骤，痢下鲜紫脓血，腹痛剧烈，厚重感特著，壮热口渴，头痛烦躁，恶心呕吐，甚者神昏惊厥，无痢下赤白黏冻，头身困重等症（A错）。湿热痢以肛门炽热，尿短赤为辨证要点，无痢下赤白黏冻，头身困重等症（B错）。阴虚痢可见痢下赤白，日久不愈，脓血黏稠，心烦口干，舌红绛少津等症，无痢下赤白黏冻，头身困重等症（C错）。休息痢以时发时止，经年不愈为辨证要点，无痢下赤白黏冻，头身困重等症（D错）。